患者，男，30岁。左侧面部切割伤48小时。创口无明显化脓性感染和组织坏死。正确的处理方法是
A. 充分清创后严密缝合
B. 充分清创后不做严密缝合
C. 充分清创后局部湿敷，待证明无感染时再缝合
D. 充分清创后简单缝合，置入引流条
E. 充分清创后简单缝合，待证明无感染时再重做严密缝合

正确答案：A。充分清创后严密缝合

解析：由于口腔颌面部血运丰富，组织再生力强，在伤后24～48小时之内，均可在清创后行严密缝合；甚至超过48小时，只要创口无明显化脓感染或组织坏死，在充分清创后，都可行严密缝合。掌握“口腔颌面部软组织创伤”知识点。